脑血栓形成患者起病24小时，有右侧偏瘫、昏迷。查体：血压160/90mmHg，脏脊液压力280mmH₂O，细胞数12x10⁶/L。治疗应首先选用
A. 静脉滴注青霉素
B. 静脉滴注能量合剂
C. 肌内注射利血平
D. 静脉滴注甘露醇
E. 静脉滴注肝素

正确答案：D。静脉滴注甘露醇